初产妇，27岁。妊娠32周，阴道少量流血及规律腹痛2小时。肛门检查宫颈管消失，宫口开大1.5cm。该患者不恰当的处理措施是
A. 静脉滴注硫酸镁
B. 使用缩宫素引产
C. 使用少量镇静剂
D. 口服沙丁胺醇
E. 左侧卧位

正确答案：B。使用缩宫素引产

解析：早产的治疗原则是，若胎膜完整尽量保胎至34周。静脉滴注硫酸镁（P61）（A对）、口服沙丁胺醇（P60）（D对）能抑制子宫收缩；使用少量镇静剂（C对）可以减轻孕妇焦躁不安，保障孕妇休息；左侧卧位（E对）能解除子宫压迫，改善血液回流，增加胎盘氧供，均有助于延长孕周。不恰当的处理措施是使用缩宫素引产（B错，为本题正确答案）。